属于易燃的危险品是
A. 高锰酸钾
B. 石油醚
C. 氯化钾
D. 氰化钾
E. 氢氧化钠

正确答案：B。石油醚

解析：本题考查易燃危险品。易燃液体包括汽油、乙醚、石油醚（B对）、乙醇、甲醇、松节油等。